某男，26岁。颜面、胸背皮疹红肿疼痛，平日皮肤油腻，伴有口臭，便秘，溲黄;舌红苔黄腻，脉滑数。诊断为粉刺，证属胃肠湿热，可选用的中成药有
A. 消痤丸
B. 金花消痤丸
C. 化瘀祛斑胶囊
D. 当归苦参丸
E. 清热暗疮片

正确答案：A、B、E。消痤丸；金花消痤丸；清热暗疮片

解析：本题考查粉刺之胃肠湿热证的中成药应用。患者诊断为粉刺，证属胃肠湿热，可选用的中成药有消痤丸（A对）、金花消痤丸（B对）、清热暗疮片（E对）。粉刺之胃肠湿热证【症状】颜面、胸背皮肤油腻，皮疹红肿疼痛，或有脓疱；伴口臭，便秘，溲黄。舌质红，苔黄腻，脉滑数。【中成药应用】常用中成药：消痤丸、金花消痤丸、清热暗疮片。化瘀祛斑胶囊（C错）【功能】疏风清热，活血化瘀。【适用病症】用于黄褐斑、酒渣、粉刺。粉刺之痰湿瘀滞证【症状】皮疹颜色暗红，以结节、脓肿、囊肿、瘢痕为主，或见窦道，经久难愈；伴纳呆腹胀。舌质暗红或有瘀斑，苔黄腻，脉弦滑。【中成药应用】常用中成药：当归苦参丸（D错）。